慢性肾功能不全的主要病机是
A. 肺脾气虚，卫表不固
B. 肾与膀胱气化失司
C. 肺气不宣，脾失健运
D. 脾肾两虚，精微下注
E. 脾肾两虚，湿浊内聚

正确答案：E。脾肾两虚，湿浊内聚

解析：慢性肾功能不全属中医“关格”范畴。水肿、淋证、癃闭等病迁延不愈，或饮食劳倦、房劳过度等因素，致肾元虚衰则出现清气不升、浊阴不降、水湿停聚，发为本病。本病病位主要在肾，涉及肺、脾（胃）、肝等脏腑，其基本病机是肾元虚衰，湿浊内蕴，为本虚标实之证（E对）。